可用塑制法制备的丸剂有
A. 蜜丸
B. 浓缩丸
C. 水丸
D. 蜡丸
E. 糊丸

正确答案：A、B、C、D、E。蜜丸；浓缩丸；水丸；蜡丸；糊丸